克拉维酸与阿莫西林配伍应用的主要药理学基础是
A. 可使阿莫西林口服吸收更好
B. 可使阿莫西林自肾小管分泌减少
C. 可使阿莫西林用量减少，毒性降低
D. 克拉维酸抗菌谱广，抗菌活性强
E. 克拉维酸可抑制β-内酰胺酶

正确答案：E。克拉维酸可抑制β-内酰胺酶

解析：本题考查克拉维酸与阿莫西林的配伍原理。克拉维酸与阿莫西林配伍应用的主要药理学基础是克拉维酸可抑制β-内酰胺酶（E对）。克拉维酸是β-内酰胺酶（E对）不可逆抑制剂，可以抑制β-内酰胺酶，与阿莫西林配伍应用，可增强对β-内酰胺酶细菌的抗菌作用。